滑石具有的功效是
A. 清热除痹
B. 清肝明目
C. 清肺化痰
D. 清热凉血
E. 清解暑热

正确答案：E。清解暑热

解析：该题考查滑石的功效，属记忆内容。滑石味甘、淡，性寒；入膀胱、肺、胃经；具有利尿通淋，清热解暑，收湿敛疮的功效（E对ABCD错）。